药物剂量过大或体内储蓄过多时发生的危害机体的反应是
A. 副作用
B. 毒性反应
C. 变态反应
D. 后遗效应
E. 特异质反应

正确答案：B。毒性反应

解析：本题考查药物的不良反应。药物剂量过大或体内储蓄过多时发生的危害机体的反应是毒性反应（B对）。毒性反应是指在药物剂量过大或体内蓄积过多时发生的危害机体的反应。副作用（A错）是指在药物按正常用法用量使用时，出现的与治疗目的无关的不适反应。变态反应（C错）是指机体受药物刺激所发生异常的免疫反应，引起机体生理功能障碍或组织损伤，又称为过敏反应。后遗效应（D错）是指在停药后血药浓度已降至最低有效浓度以下时仍残留的药理效应。特异质反应（E错）是指少数特异体质患者对某些药物反应异常敏感。